知母配川贝母善治
A. 阴虚劳嗽
B. 风寒咳嗽
C. 肺燎晐嗽
D. 寒饮喘咳
E. 肝火犯肺咳痰带血

正确答案：C、E。肺燎晐嗽；肝火犯肺咳痰带血